关于下颌侧切牙的描述错误的是
A. 体积较下颌中切牙大
B. 下颌侧切牙的唇面较下颌中切牙的唇面稍宽
C. 远中切角较近中切角圆钝
D. 邻面近中接触区距离切角远，远中接触区距离切角较近
E. 根尖偏远中

正确答案：D。邻面近中接触区距离切角远，远中接触区距离切角较近

解析：本题考查上下颌前牙的外形及临床应用解剖。下颌侧切牙邻面：似三角形，近中接触区位于切1/3近切角处；远中接触区在切1/3距切角稍远处。所以D项错误。其余内容均正确。